表现为强迫性思维的是
A. 抑郁症
B. 急性精神分裂症
C. 慢性精神分裂症
D. 强迫性神经症
E. 癔症性精神病

正确答案：D。强迫性神经症

解析：强迫性精神症表现为强迫思维（D对）。抑郁症表现为思维迟缓（A错）。急性精神分裂症可表现为思维破裂（B错）。思维贫乏可见于精神分裂症的晚期或慢性阶段（C错）。 本题主要考查学生掌握思维障碍常见于相应的精神疾病。